传统养护技术具有经济、有效、简便易行等优点，是目前饮片贮存养护中重要的基础措施，下列不可作为干燥剂的是
A. 木炭
B. 硅胶
C. 生石灰
D. 生石膏
E. 无水氯化钙

正确答案：D。生石膏

解析：本题考查中药传统养护技术。传统养护技术具有经济、有效、简便易行等优点，是目前饮片贮存养护中重要的基础措施，下列不可作为干燥剂的是生石膏（D错，为本题正确答案）。库房密封贮藏法：如密封或密闭前后库内湿度较高或因密封、密闭不严，外界潮气会不断侵入，可加入木炭（A对）、硅胶（B对）、生石灰（C对）等吸湿剂，这样密封和吸湿结合，可取得较好的养护效果。无水氯化钙（E对），是一种白色无定形的固体，呈粒状、块状或粉状。吸潮率可达100%～120%。